女性，28岁。干咳、低热、盗汗半月，今日突然咯血两口而就诊。左上肺可闻及湿啰音。首先考虑的诊断是
A. 肺炎球菌肺炎
B. 支气管扩张
C. 肺脓肿
D. 肺结核
E. 肺癌

正确答案：D。肺结核

解析：患者为青年女性，干咳、低热、盗汗半月（为肺结核的典型临床表现），突发咯血，符合肺结核的临床表现，考虑诊断为肺结核（D对）。肺炎球菌肺炎（P46）（A错）起病急骤，发病前多有诱因，典型症状为发热、胸痛、咳铁锈色痰，且不会出现咯血。支气管扩张（P37）（B错）病程较长，典型的症状有慢性咳嗽、咳大量脓痰和反复咯血。肺脓肿（P58）（C错）主要特征为高热、咳嗽和咳大量脓臭痰，而不是该患者的低热。肺癌（P77）（E错）多见于中老年人，早期表现为刺激性咳嗽或血痰，胸闷、哮鸣、气促、发热、胸痛等。